可引起继发性肺动脉高压最常见的病因是
A. 慢性阻塞性肺疾病
B. 结缔组织病
C. 肺结核
D. 肺血栓栓塞
E. 间质性肺炎

正确答案：A。慢性阻塞性肺疾病

解析：继发性肺动脉高压远比原发性肺动脉高压常见，其基础疾病常为呼吸性疾病，是由支气管-肺组织、胸廓或肺血管病变致肺血管阻力增加所致，以慢阻肺（COPD）最为常见（A对），COPD时，机体缺氧和二氧化碳潴留，使肺血管收缩、痉挛，其中缺氧是最重要的因素，此时收缩血管的活性物质增多，肺血管收缩，血管阻力增加，肺动脉高压形成。结缔组织病、肺结核、间质性肺炎、PE（肺栓塞）均可引起继发性肺动脉高压，但不如COPD常见。